表示疾病流行强度的术语是
A. 散发 暴发 流行 大流行
B. 周期性 季节性 长期变动
C. 发病率 患病率 死亡率
D. 传染性 易感性 免疫性
E. 以上均不是

正确答案：A。散发 暴发 流行 大流行

解析：本题考查疾病流行强度术语。疾病流行强度常用散发、暴发、流行及大流行（A对BCDE错）表示，指在一定时期内疾病在某地区人群中发病率的变化及其病例间的联系程度。